男，62岁。间断上腹痛10余年，加重伴餐后上腹胀3年，胃镜见幽门前区大弯侧直径1.5cm范围黏膜不平，活检病理示重度异型增生。最适当的处理方式是
A. 近期进行胃镜下黏膜切除术
B. 口服质子泵抑制剂治疗，近期复查
C. 口服胃黏膜保护剂，近期复查
D. 近期进行胃大部切除术
E. 口服H₂受体拮抗剂，近期复査

正确答案：A。近期进行胃镜下黏膜切除术

解析：胃黏膜上皮的异型增生可分为轻、中、重三种，对中、重度异型增生无淋巴结转移的患者宜予预防性手术治疗，目前多采用胃镜下黏膜切除术（A对）。口服质子泵抑制剂或胃黏膜保护剂或H₂受体拮抗剂，近期复查（BCE错）适用于轻度异型增生的患者。对重度异型增生伴淋巴结转移患者宜行胃大部切除术（D错）。